女，38岁。接触性出血1月余，白带有恶臭。妇科检查：宫颈Ⅱ度糜烂，前唇有5cm×3cm的质地脆赘生物、易出血。子宫正常大，三合诊（-）。为确定诊断最可靠的诊断方法为
A. 宫颈刮片细胞学检查
B. 碘试验
C. 阴道镜检查
D. 氮激光肿瘤固有荧光诊断法
E. 宫颈活检

正确答案：E。宫颈活检

解析：该患者有接触性出血1个月余（子宫颈癌患者常表现为接触性阴道流血），白带有恶臭（子宫颈癌患者晚期因癌组织坏死伴感染，可有脓性恶臭白带）、宫颈Ⅱ度糜烂（子宫颈癌患者子宫颈表现为光滑或糜烂样改变）、前唇有5cm×3cm的质地脆赘生物、易出血（外生型子宫颈癌可见息肉状或菜花状赘生物，质脆易出血），子宫正常大小，结合患者的临床表现，可诊断为子宫颈癌。子宫颈癌最可靠的诊断方法为宫颈活检（E对），宫颈活检是子宫颈癌诊断的确诊依据。宫颈刮片细胞学检查（A错）主要作为初步筛选，用于妇女的子宫颈癌普查（P404）。碘试验（B错）为宫颈癌初筛方法，不是确诊方法（P444）。阴道镜检查（C错）可以对可疑部位进行定位活检，以提高宫颈疾病的确诊率，但不是子宫颈癌的确诊方法（P443）。氮激光肿瘤固有荧光诊断法（D错）可用于临床诊断体表及体内凡光导纤维可触及部位的恶性肿瘤，仅作为宫颈癌的诊断依据，但不是确诊方法。